根据牙列缺损的Kennedy分类，874321|1278缺失者属于
A. 第一类第二亚类
B. 第一类第一亚类
C. 第二类第一亚类
D. 第四类第二亚类
E. 第四类

正确答案：B。第一类第一亚类

解析：本题考查Kennedy牙列缺损分类。874321|1278缺失是双侧后牙缺失，远中无天然牙存在，属于第一类；前牙部分缺失32112，是连续缺失，只有一个缺隙，属于第一亚类（B对A错）。第二类第一亚类指牙弓一侧后部牙缺失，远中无天然牙存在且还存在一个缺牙间隙（C错）。第四类（DE错）指牙弓前部牙连续缺失并跨过中线，天然牙在缺隙远中，为单缺隙，无亚类，因为要以最后的缺牙间隙决定分类，如果第四类还存在别的缺牙间隙，则就不属于第四类了。